测定蛋白样品中某种相对分子质量的蛋白选用最佳的方法是
A. 免疫PCR
B. ELISA法
C. 蛋白印迹试验（Western blotting）
D. 斑点杂交
E. Southern blotting

正确答案：C。蛋白印迹试验（Western blotting）